引起发热最常见的病因是
A. 变态反应
B. 病毒感染
C. 细菌感染
D. 恶性肿瘤
E. 无菌性炎症

正确答案：C。细菌感染

解析：革兰氏阴性细菌的胞壁中所含的内毒素是最常见的外致热原，是血液制品和输液过程中的主要污染物，故细菌感染（C对）是引起发热最常见的原因。变态反应（A错）、病毒感染（B错）、恶性肿瘤（D错）、无菌性炎症（E错）虽然都可以引起发热，但不是引起发热最常见的原因。